关于抗精神病药氯丙嗪不良反应的说法，正确的是
A. 无心血管系统不良反应
B. 与氟哌啶醇相比，诱发癫痫发作的风险更高
C. 有抗胆碱能作用，表现为口干、视物模糊、便秘和尿潴留症状
D. 常见无黄疸性肝功能异常和一过性丙氨酸氨基转移酶升高
E. 引起的锥体外系不良反应与阻断多巴胺D₂受体密切相关

正确答案：B、C、D、E。与氟哌啶醇相比，诱发癫痫发作的风险更高；有抗胆碱能作用，表现为口干、视物模糊、便秘和尿潴留症状；常见无黄疸性肝功能异常和一过性丙氨酸氨基转移酶升高；引起的锥体外系不良反应与阻断多巴胺D₂受体密切相关

解析：本题考查氯丙嗪的不良反应。氯丙嗪的不良反应包括：1.阻断多巴胺D₂受体（E对）引起锥体外系反应。2.外周抗胆碱能作用，表现有口干、视物模糊、便秘和尿潴留等（C对）。3.肝功能损害：常见的是无黄疽性肝功能异常，一过性的丙氨酸氨基转移酶升高（D对），多能自行恢复。4.氯丙嗪诱发癫病发作的风险高于氟哌啶醇（B对）。